预防霍乱、副霍乱
A. 丙种球蛋白
B. 类毒素或抗病毒
C. 活疫苗
D. 化学药品
E. 灭活菌苗

正确答案：E。灭活菌苗

解析：本题考查霍乱、副霍乱的预防。预防霍乱、副霍乱可接种灭活菌苗（E对ABCD错）。灭活疫苗是选用免疫原性强的病原体，经人工培养后，用理化的方法灭活后制成的疫苗。